弥漫性细支气管肺泡癌的典型痰液为
A. 大量白色泡沫状痰
B. 大量脓性痰，有分层
C. 大量粉红色泡沫痰
D. 大量乳状痰
E. 大量白色黏液样痰

正确答案：E。大量白色黏液样痰

解析：肺癌早期症状一般为刺激性干咳，但肺泡细胞癌可出现大量痰液，在不伴感染的情况下，为白色黏液痰（E对），是弥漫性支气管肺泡癌的典型痰液。大量白色泡沫状痰（A错）一般见于慢性左心衰（P166），也可见于慢性支气管炎和慢性阻塞性肺疾病。大量脓性痰伴分层（B错）可出现在肺脓肿（P57）以及支气管扩张症（P37）。大量粉红色泡沫痰（C错）常出现于急性左心衰（P175）。大量乳状痰一般见于金黄色葡萄球菌肺炎（金黄色葡萄球菌肺炎痰液也被认为是红色乳状痰）（D错）。